下面的甜味剂有防龋作用的是
A. 白砂糖
B. 绵白糖
C. 红糖
D. 甜叶菊糖
E. 果糖

正确答案：D。甜叶菊糖

解析：蔗糖的替代品有两种，一种为高甜度的代用品，如糖精、甜叶菊糖比蔗糖甜若干倍，同时有弱抑菌作用，所以有一定的防龋作用。掌握“龋病流行病学”知识点。